制备流浸膏剂，饮片提取多采用
A. 稀释法
B. 渗漉法
C. 浸渍法
D. 煎煮法
E. 水蒸气蒸馏法

正确答案：B。渗漉法

解析：本题考查的是流浸膏剂的制备方法。制备流浸膏剂，饮片提取多采用渗漉法（B对）。除另有规定外，流浸膏剂用渗漉法制备，也可用浸膏剂稀释制成。浸膏剂用煎煮法、回流法或渗漉法制备。全部提取液应低温浓缩至稠膏状，加稀释剂或继续浓缩至规定的量。渗漉法：是不断向粉碎的中药材中添加新鲜浸出溶剂，使其渗过药材，从渗漉筒下端出口流出浸出液的一种方法。但该法消耗溶剂量大、费时长，操作比较麻烦。稀释法（A错）为酊剂与流浸膏剂的制备方法。浸渍法（C错）：是在常温或温热（60℃～80℃）条件下用适当的溶剂浸渍药材以溶出其中有效成分的方法。本法适用于有效成分遇热不稳定的或含大量淀粉、树胶、果胶、黏液质的中药的提取。但本法出膏率低，需要特别注意的是当水为溶剂时，其提取液易于发霉变质，需注意加入适当的防腐剂。煎煮法（D错）：是中药材加入水浸泡后加热煮沸，将有效成分提取出来的方法。此法简便，但含挥发性成分或有效成分遇热易分解的中药材不宜用此法。水蒸气蒸馏法（E错）：适用于具有挥发性的、能随水蒸气蒸馏而不被破坏，且难溶或不溶于水的化学成分的提取。此类化合物的沸点多在100℃以上，并在100℃左右有一定的蒸气压。